早萌的乳牙的牙位多见于
A. 上颌乳中切牙
B. 下颌乳中切牙
C. 上颌乳侧切牙
D. 下颌乳尖牙
E. 第一乳磨牙

正确答案：B。下颌乳中切牙

解析：本题考查乳牙滞留和乳牙早萌。早萌的乳牙分为诞生牙和新生牙，均多见于下颌乳中切牙（B对）。